女，55岁，5个月来乏力面色苍白，既往体健。化验Hb72g/L，WBC3.5x10⁹/L，分类N65%，L32%，M3%，Plt45x10⁹/L，骨髓增生明显活跃，原始细胞15%，可见Auer小体，全片见巨核细胞48个，易见小巨核细胞，骨髓细胞外铁（++），内可见环状铁粒幼细胞10%。临床考虑MDS，根据FAB分型最可能的类型是
A. RA型
B. RAS型
C. RAEB型
D. RAEB-t型
E. CMML型

正确答案：D。RAEB-t型

解析：患者中老年女性，5个月来乏力、面色苍白（贫血表现），临床考虑MDS，化验Hb72g/L（成年女性正常值110～150g/L）提示贫血，WBC3.5×10⁹/L（正常4～10×10⁹/L），分类N65%（中性粒细胞比例正常50%～75%），L32%（淋巴细胞比例正常20%～40%），M3%（单核细胞比例正常3%～8%），白细胞总数减少，各类白细胞比例正常，Plt45×10⁹/L（正常100～300×10⁹/L）减少，提示两系减少，骨髓象示骨髓增生明显活跃，原始细胞15%（RA（A错）、RAS（B错）骨髓原始细胞＜5%），可见Auer小体（RAEB-t型骨髓原始细胞＞20%而＜30%或幼粒细胞出现Auer小体，Auer小体是RAEB-t型特征性的变化），全片见巨核细胞48个（正常值7～35个），易见小巨核细胞，骨髓细胞外铁（++），内可见环状铁粒幼细胞10%（RAS（B错）环状铁粒幼细胞＞有核红细胞的15%），故患者FAB分型最可能的类型是RAEB-t型（D对）。RAEB型（C错）、CMML型（E错）骨髓原始细胞5%～20%，但无Auer小体。